移行为输尿管的是
A. 肾小盏
B. 肾大盏
C. 肾盂
D. 肾小管
E. 肾乳头

正确答案：C。肾盂

解析：肾盂（C对）平第2腰椎上缘移行为输尿管